下述哪项不是脂类的主要生理功能
A. 储能和功能
B. 生物膜的组成
C. 脂类衍生物的调节作用
D. 营养必须脂肪酸
E. 氮平衡

正确答案：E。氮平衡